促进胃液分泌的因素
A. 胆盐与胆囊收缩素
B. 乙酰胆碱与组胺
C. 盐酸与脂肪
D. 抑胃肽与胆囊收缩素
E. 促胰液素与胆囊收缩素

正确答案：B。乙酰胆碱与组胺

解析：促进胃液分泌的主要因素：（1）迷走神经：迷走神经中有传出神经纤维直接到达胃黏膜泌酸腺中的壁细胞，通过末梢释放ACh（乙酰胆碱）而引起胃酸分泌；（2）组胺：组胺具有极强的促胃酸分泌作用。它由ECL细胞分泌，以旁分泌的方式作用于邻旁壁细胞的H₂型受体，引起壁细胞分泌胃酸（B对）；（3）促胃液素。消化期在食物入胃后可刺激盐酸（P188）（C错）分泌，当盐酸分泌过多时，可负反馈抑制胃酸分泌。缩胆囊素（P190）（ADE错）既可刺激基础胃酸分泌，又有能竞争性抑制促胃液素刺激胃酸分泌的作用，但对胃酸分泌主要表现为抑制作用。抑胃肽（P190）（D错）可通过生长抑素介导而抑制胃酸分泌。促胰液素（P1891）（E错）使一种肠抑胃素，是胃酸分泌的抑制剂。